女性，32岁。低热、胸闷、气促15天。查体：颈静脉怒张，心界向两侧明显扩大，坐位时呈三角形，仰卧位心底部浊音区增宽，此病人很可能的诊断是
A. 急性心肌梗死
B. 缩窄性心包炎
C. 扩张型心肌病
D. 缺血性心肌病
E. 结核性心包炎伴心包积液

正确答案：E。结核性心包炎伴心包积液

解析：本例患者为青年女性，低热、胸闷、气促15天，提示可能患有结核病，查体见颈静脉怒张，心界向两侧明显扩大，坐位时呈三角形，仰卧位心底部浊音区增宽提示存在心包积液造成心脏压塞，故此病人很可能的诊断是结核性心包炎伴心包积液（E对）。急性心肌梗死（A错）主要表现为胸骨后濒死样痛，舌下含服硝酸甘油不能缓解，心界一般不大。缩窄性心包炎（B错）症状与心输出量下降和体循环淤血有关，常表现为劳力性呼吸困难、活动耐量下降以及肝大、颈静脉怒张等，心脏X线检查可见心影偏小、正常或轻度增大，左右心缘变直。扩张型心肌病（C错）症状与左心功能不全有关，主要表现为活动时呼吸困难和活动耐量下降，严重者可并发右心功能不全，心脏X线检查可见心影增大，心胸比＞50%。缺血性心肌病（D错）是冠心病的一种类型，主要表现为心前区胸痛，常无颈静脉怒张，查体时心脏常无明显异常体征。